肉豆蔻炮制的目的是
A. 缓和药性
B. 增强疗效
C. 两者均是
D. 两者均不是

正确答案：B。增强疗效

解析：本题考查的是肉豆蔻的炮制作用。肉豆蔻炮制的目的是增强疗效（B对）。煨法是将净制或切制后的药物用湿面皮或湿纸包裹，或吸油纸均匀隔层分放，进行加热处理，或将药物与麦麸同置炒制容器内用文火加热至规定程度的方法。煨法的目的：①除去药物中部分挥发性及刺激性成分，从而降低副作用，如肉豆蔻。②增强疗效，如肉豆蔻。③缓和药性（A错），如诃子、葛根。